为促进尿酸的排出，痛风患者应每天保证摄入充足的
A. 主食
B. 畜肉
C. 水产品
D. 牛奶、鸡蛋
E. 水

正确答案：E。水

解析：本题考查痛风患者促进尿酸的排出。痛风患者应每天保证摄入充足的水（E对ABCD错），维持一定的尿量促进尿酸排泄，防止尿酸盐的形成和沉积。